与人口净密度最无关系的是
A. 每人居住面积定额
B. 建筑层数
C. 居住区用地面积
D. 居住建筑密度
E. 平面系数

正确答案：C。居住区用地面积

解析：本题考查与人口净密度有关的指标。单位住宅用地上居住的人口数量，称为人口净密度。与人口净密度有关系的指标有：每人居住面积定额（A对）、建筑层数（B对）、居住建筑密度（D对）、平面系数（E对）等。居住区用地面积（C错，为本题正确答案）与人口净密度最无关系。